男性，16岁。低热、咳嗽、咽部不适2周，胸部X线片示两肺下部网状及按小叶分布的斑片状浸润阴影，血WBC10×10⁹/L。首选哪项检查以确定诊断
A. 痰细菌培养
B. 痰真菌培养
C. 冷凝集试验
D. 血清抗体测定
E. 痰抗酸杆菌涂片

正确答案：D。血清抗体测定

解析：患者青少年男性（支原体肺炎的好发年龄），发热、咳嗽、咽部不适，胸部X线片示两肺下部网状及按小叶分布的斑片状浸润阴影（支原体肺炎的典型胸片改变），血WBC10×10⁹/L（正常值4～10×10⁹/L）。结合患者临床表现和辅助检查，可初步诊断为支原体肺炎。血清抗体测定如血清支原体IgM抗体（D对）≥1：64，或恢复期抗体滴度有4倍增高，可进一步确诊。痰细菌培养（A错）用于确定细菌性肺炎的病原菌，该患者考虑为支原体感染，故不作为首选的检查。痰真菌培养（B错）用于诊断肺部真菌感染，肺部真菌的感染是由于广泛使用广谱抗菌药物、糖皮质激素、细胞毒药物导致体内正常菌群失调，该患者没有大量用药史，故不首选痰细菌培养。冷凝集试验（C错）在支原体肺炎多在起病两周后为阳性，滴度≥1：32，如果滴度逐步增高，更有诊断价值。痰抗酸杆菌涂片（E错）用于检出结核杆菌的感染，该患者的临床表现及辅助检查不符合结核病，故不首选痰抗酸杆菌涂片。